2002年12月广西某地山区一辆满载数吨剧毒化学品砒霜的卡车翻落在深山峡谷中，大部分毒物抛撒到谷底的河流里，而下游15km的居民则以这条河的水作为饮用水水源。为防止河水污染对居民健康的危害，领导派你对河水进行监测，由于条件和时间的限制，你认为采集水样最重要的河流断面是
A. 距事故下游最近的居民取水点上游1000m和取水点处
B. 事故点的上游1000m和下游100m
C. 事故点下游最近居民取水点上游1000m和下游100m
D. 事故发生地点
E. 事故点下游7.5km处

正确答案：A。距事故下游最近的居民取水点上游1000m和取水点处

解析：本题考查采样断面的选择。距事故下游最近的居民取水点上游1000m和取水点处（A对BCDE错）是采集水样最重要的河流断面。因为居民取水点处是最有可能受到剧毒污染的河流断面，所以最重要的是进行监测，以确保居民的饮用水安全。